硬脂酸三乙醇胺皂可作为气雾剂的
A. 金属离子络合剂
B. 乳化剂
C. 抛射剂
D. 抗氧剂
E. 矫味剂

正确答案：B。乳化剂

解析：本题考查的是气雾剂的附加剂。硬脂酸三乙醇胺皂可作为气雾剂的乳化剂（B对）。气雾剂的乳化剂的有硬脂酸三乙醇胺皂、聚山梨酯类等。注射剂的金属离子络合剂（A错）：有些注射剂，常因药液中含有微量金属离子的存在，而加速主药的氧化、变质，可加入能与金属离子络合的络合物，使与金属离子生成稳定的水溶性络合物，阻止其促进氧化，使药液稳定。常用的金属离子络合剂有乙二胺四乙酸（EDTA）、乙二胺四乙酸二钠（EDTA-2Na）等，常用量为0.03%～0.05%。气雾剂的抛射剂（C错）：为适宜的低沸点液化气体。抛射剂是喷射药物的动力，有时兼作药物的溶剂和稀释剂。根据气雾剂所需压力，可将两种成几种抛射剂以适宜比例混合使用。（1）氢氟烷烃类。（2）二甲醚。（3）碳氢化合物。（4）惰性气体。注射剂的抗氧剂（D错）：抗氧剂是一类易被氧化的还原剂。常用的抗氧剂有亚硫酸钠、亚硫酸氢钠和焦亚硫酸钠等，一般浓度为0.1%～0.2%。其中亚硫酸钠常用于偏碱性药液，亚硫酸氢钠和焦亚硫酸钠常用于偏酸性药液。胶囊的矫味剂（E错）：芳香矫味剂，如乙基香草醛等，可调整胶囊剂的口感等。